老年人容易发生负钙平衡的原因不包括
A. 胃液分泌减少
B. 肾脏功能降低
C. 心脏功能降低
D. 钙吸收减少
E. 户外活动减少

正确答案：C。心脏功能降低